拇指腕掌关节
A. 由大多角骨和第一掌骨底构成
B. 是典型的球窝关节
C. 对掌运动即为握掌运动
D. 由第一掌骨头和拇指近节指骨底构成
E. 无

正确答案：A。由大多角骨和第一掌骨底构成

解析：拇指腕掌关节由大多角骨和第1掌骨底构成（A对D错），属于鞍状关节（B错）。对掌运动是拇指尖与其余四指尖掌侧面相接触的运动，手指未全部接触，并非握掌运动（C错）。